男，14岁，秋游后低热、乏力、咳嗽、少量粘痰2周。X线胸片示两下肺网状及按小叶分布的斑片状浸润阴影。血白细胞9.8×10⁹/L。患者最可能的疾病是
A. 浸润型肺结核
B. 病毒性支气管炎
C. 军团菌肺炎
D. 支原体肺炎
E. 念珠菌肺炎

正确答案：D。支原体肺炎